抗结核药物治疗中属抑制细菌的药物是
A. 利福平
B. 异烟肼
C. 吡嗪酰胺
D. 乙胺丁醇
E. 链霉素

正确答案：D。乙胺丁醇

解析：目前临床上对于结核的治疗多采用抗结核药化学治疗的方案，常用的抗结核药根据其作用机制可分为杀菌药与抑菌药，其中异烟肼（B错）、利福平（Q错）、链霉素（E错）、吡嗪酰胺（C错）属于杀菌药，乙胺丁醇（D对）属于抑菌作用的抗结核药物。